王某，女，75岁。患病后始终不愿就诊，而是在家中烧香拜佛祈求病愈。王某的儿见母亲病情加重，便请社区医师到家里为其母诊治，但遭到王某拒绝。医师符合伦理的做法是
A. 鉴于患者拒绝，社区医师应放弃诊治
B. 对患者信佛不信医的行为进行批评
C. 向患者进行耐心解析，规劝其接受相应诊治
D. 在家属协助下，对患者实施强制诊治
E. 患者行为影响健康，应及时报告派出所处置

正确答案：C。向患者进行耐心解析，规劝其接受相应诊治

解析：有利原则是要求医务人员的诊治行为应尽力保护患者的利益，努力促进并维护患者的生命健康，首先考虑对患者有益的事，如题干中患者因信奉烧香拜佛祈求病愈而拒绝其儿子为她请来的社区医师的诊治，该患者是由于不理智的观点而将导致自己生命健康受到损害，医师应遵循有利原则，首先考虑患者的生命健康和知情同意权，应争取向患者进行耐心解析，规劝其接受相应诊治（C对），从而努力促进和维护患者的生命健康。